内关穴主治除哪项以外的病症
A. 心悸，心痛，心律失常
B. 小便不利，水肿
C. 胃痛，呃逆，呕吐
D. 中风偏瘫，失眠，癫狂痫
E. 眩晕，偏头痛

正确答案：B。小便不利，水肿

解析：内关主治：1、心痛、胸闷，心动过速或过缓（A对）；2、胃痛、呕吐、呃逆等胃腑病证（C对）；3、中风、偏瘫、眩晕、偏头痛（E对）；4、失眠、郁证、癫狂等神志病证（D对）；5、上肢痹痛等。内关不治疗小便不利，水肿（B错，为本题正确答案）。